世界卫生组织将卵巢功能开始衰退直至绝经后1年内的时期称为
A. 绝经过渡期
B. 性成熟期
C. 绝经后期
D. 老年期
E. 围绝经期

正确答案：E。围绝经期

解析：世界卫生组织将卵巢功能开始衰退直至绝经后1年内的时期称为围绝经期。掌握“女性生殖系统生理”知识点。